患者，女，63岁，因心绞痛急诊就医，诊断为ST段抬高心肌梗死，血压175/95mmHg，心率110次/分，该患者适宜使用的药物是
A. 硝普钠
B. 美托洛尔
C. 氨氯地平
D. 贝那普利
E. 氢氯噻嗪

正确答案：C。氨氯地平

解析：本题考查氨氯地平。氨氯地平（C对）适用于高血压，稳定型心绞痛和变异型心绞痛的治疗。题干中，患者血压175/95mmHg，心绞痛，ST段抬高心肌梗死，符合氨氯地平的适应证。硝普钠（A错）用于高血压急症，如高血压危象、高血压脑病、恶性高血压、急性心力衰竭，包括急性肺水肿等。美托洛尔（B错）用于治疗高血压、心绞痛、心肌梗死、肥厚型心肌病、主动脉夹层、心律失常、甲状腺机能亢进、心脏神经官能症等，近年来尚用于心力衰竭的治疗。贝那普利（D错）用于各期高血压，充血性心力衰竭，作为对洋地黄和（或）利尿剂反应不佳的充血性心力衰竭病人（NYHA分级Ⅱ-Ⅳ）的辅助治疗。氢氯噻嗪（E错）用于水肿性疾病、高血压、中枢性或肾性尿崩症、肾石症。